苦寒清泄，甘寒滋润的药是
A. 知母
B. 石膏
C. 紫草
D. 淡竹叶
E. 地骨皮

正确答案：A。知母

解析：本题考查的是知母的性能特点。苦寒清泄，甘寒滋润的药是知母（A对）。知母：【性能特点】本品苦泄寒清，甘润滋滑，既入肺、胃经，又入肾与大肠经。但清降，不透散，并滋阴。上清肺热而泻火，中清胃热而除烦渴，下滋肾阴而润燥滑肠、退虚热。清热泻火虽不及石膏，但长于滋阴润燥，驱邪扶正两相兼。实火、虚热皆宜，高热或燥热津伤及阴虚发热者用之尤佳。石膏（B错）：【性能特点】本品生用辛甘大寒，主清泄，兼透解，入肺、胃经，既善清泄气分实热和肺胃实火，又兼能解肌透热，热去则烦除、津生、渴止，为治气分高热和肺胃实火之要药。煅后涩凉，主收敛，兼清泄，外用能收敛生肌，兼清热，为治疮疡湿疹所常用。紫草（C错）：【性能特点】本品苦寒清泄，甘寒清解滑利，咸而色紫入血，入心、肝经。既清热凉血，使热毒从内而解，又活血化瘀，促进斑疹瘀血迅速消散，以解毒透疹；滑利二便，导热毒、疹毒从二便排出。集凉血、活血、解毒、透发斑疹、滑利二便于一体。凡斑痘疹毒之疾，见血热毒盛、色不红活，或伴高热者即可选用，尤宜斑疹紫黑兼二便秘涩者。淡竹叶（D错）：【性能特点】本品甘淡性寒清利，入心、小肠、膀胱经，能清心除烦、利尿通淋。与竹叶相比，唯以清利，不兼透散；又入膀胱经，利尿通淋力较强，热淋涩痛多用；兼入小肠经，治心火移热于小肠宜用，疗热病烦渴、热淋、水肿兼热及湿热黄疸可投。地骨皮（E错）：【性能特点】本品甘寒清降益润，入肺、肝、肾经。既退虚热、凉血热、泄肺火，又略兼益阴而生津。治有汗骨蒸最宜，治血热出血可选，治肺热咳嗽常用。